着床前的胚胎易发生
A. 生长迟缓
B. 受精卵死亡
C. 致畸作用
D. 母体毒性
E. 母体死亡

正确答案：B。受精卵死亡